一般和特殊（味觉）内脏感觉纤维的终止核是
A. 下泌涎核
B. 疑核
C. 孤束核
D. 迷走神经背核
E. 无

正确答案：C。孤束核

解析：孤束核（C对）是一般和特殊（味觉）内脏感觉纤维的终止核，小的上部属特殊内脏感觉核，大的下部称心－呼吸核，为一般内脏感觉核；下泌涎核（A错）发出副交感神经的节前纤维进入 舌咽神经，经其分支岩小神经至耳神经节换元，节后纤维管理腮腺的分泌；疑核（B错）接受双侧皮质核束纤维的传入；迷走神经背核（D错）节后纤维支配颈部、胸部所有脏器和腹腔大部分脏器的平滑 肌、心肌的活动和腺体的分泌；Ⅴ、Ⅵ和Ⅹ脑神经（E错）均为传导纤维，并非终止核。